我国现存最早的本草著作是
A. 《神农本草经》
B. 《新修本草》
C. 《经史证类备急本草》
D. 《本草纲目》
E. 《植物名实图考》

正确答案：A。《神农本草经》

解析：本题考查的是《神农本草经》。我国现存最早的完整本草著作是《神农本草经》（A对）。《神农本草经》简称《本经》，为汉代本草代表作。该书虽假托传说中的神农而作，但并非出于一时一人之手，而是经历了较长时间的补充和完善。该书系统总结了汉代以前我国药学发展的成就，是现存最早的药学专著，为本草学的发展奠定了基础。《新修本草》（B错）又称《唐本草》，为隋唐时期唐代的本草代表作。书中除本草正文外，还增加了药物图谱，并附以文字说明，开创了图文对照法编撰药学专著的先例。《经史证类备急本草》（C错）简称《证类本草》，为宋金元时期宋代的本草代表作。作者唐慎微，全书共30卷，载药1746种，附方3000余首。该书图文对照，方药并收，医药结合，资料翔实，集宋以前本草之大成，使大量古代文献得以保存，具有极高的学术价值和文献价值。《本草纲目》（D错）简称《纲目》，为明代本草代表作。该书的作者为伟大医药学家李时珍，他采用多学科综合研究的方法，以毕生精力对本草学进行了全面深入的研究整理。《植物名实图考》（E错），植物学著作，38卷。该书考订植物名实，然涉及药用植物甚多。共载植物1714种，仿《本草纲目》分谷、蔬、山草、隰草、石草、水草、蔓草、芳草、毒草、群芳、果、木12类。附图1805幅，绝大多数系写生而成。书中一般一物一图，图文对照。